传染病的基本特征是
A. 有传染性、传染途径和免疫性
B. 有传染性、免疫性和流行性
C. 有病原体、免疫性与传染性
D. 有病原体、免疫性、传染性、流行性、地方性、季节性
E. 有传染性、流行性、地方性、季节性及暴发性

正确答案：D。有病原体、免疫性、传染性、流行性、地方性、季节性